王某，女性，26岁。1个月前出现发热，热势多为低热，头晕眼花，体倦乏力，心悸不宁，面白少华，唇甲色淡，舌质淡，脉细弱。治疗应选用的方剂是
A. 清骨散
B. 金匮肾气丸
C. 补中益气汤
D. 丹栀逍遥散
E. 归脾汤

正确答案：E。归脾汤

解析：患者主诉为发热，且热势多为低热，故诊断患者为内伤发热。血本属阴，阴血不足则无以敛阳，因而引起发热。血虚不能上滋头目，外濡肢体，故见头晕眼花，身倦乏力。血不养心则心悸不宁。血虚不能上荣于面及充盈血脉，故致面白少华，唇甲色淡，舌淡，脉细弱，故患者为血虚发热，治以益气养血，代表方为归脾汤加减（E对）。清骨散为阴虚发热的选方（A错）。金匮肾气丸为阳虚发热的代表方剂（B错）。补中益气汤为气虚发热证的主方（C错）。丹栀逍遥散为气郁发热的选方（D错）。